舌胖大有齿痕
A. 肺虚
B. 脾虚
C. 肝虚
D. 心虚
E. 肾虚

正确答案：B。脾虚

解析：本题考望舌质的主要内容及临床意义。查舌胖大有齿痕为脾虚（B对）。齿痕：舌体的边缘见牙齿的痕迹，即为齿痕舌。多因舌体胖大而受齿缘压迫所致，故齿痕舌常与胖大舌同见，多属脾虚。若舌质淡白而湿润，多为脾虚而寒湿壅盛。胖大舌：较正常舌体胖大，为胖大舌。有胖嫩与肿胀之分。若舌体胖嫩，色淡，多属脾肾阳虚（E错）、津液不化、水饮痰湿阻滞所致；如舌体肿胀满口，色深红，多是心脾热盛；若舌肿胖，色青紫而暗，多见于中毒。